逆行性牙髓炎最少见的检查所见是
A. 有深牙周袋
B. 牙松动
C. 叩诊疼痛
D. 伴有引发牙髓炎的深龋或其他牙体硬组织疾病
E. 牙龈水肿、充血

正确答案：D。伴有引发牙髓炎的深龋或其他牙体硬组织疾病

解析：本题考查逆行性牙髓炎。因为逆行性牙髓炎是牙周病变引起的牙髓病变，因此不应出现伴有引发牙髓炎的深龋或其他牙体硬组织疾病（D错，为本题的正确答案）。逆行性牙髓炎的感染来源于患牙牙周炎所致的深牙周袋（A对），袋内的细菌及毒素通过根尖孔或侧、副根管逆行进入牙髓，引起根部牙髓的慢性炎症，是牙周-牙髓联合病变的一型，既有牙髓病变的症状又有牙周病变的症状（E对）。由于病变深达根尖，根尖周组织的炎症可造成叩诊疼痛（C对），且根尖周支持组织的病变可导致牙有松动（B对）。